头孢菌素7-α氢原子换成甲氧基后，可以
A. 扩大抗菌谱，提高抗菌活性
B. 增加对β-内酰胺酶的稳定性
C. 对抗菌活性有较大影响
D. 明显改善抗菌活性和药物代谢动力学性质
E. 不引起交叉过敏反应

正确答案：B。增加对β-内酰胺酶的稳定性

解析：本题考查头孢菌素类抗菌药。头孢菌素7-α氢原子换成甲氧基后，可以增加对β-内酰胺酶的稳定性（B对）；头孢菌素7位的酰胺基是抗菌谱的决定性基团，对扩大抗菌谱提高抗菌活性有至关重要的作用（A错）；头孢菌素的C-3位甲基以卤素替代得到的新型头孢菌素可明显改善其药动学性状，对抗菌活性也产生较大影响（C错）；头孢菌素3位取代基的改造可明显的改变抗菌活性和药物动力学性质（D错）；为避免使用头孢菌素发生交叉过敏反应，如对青霉素过敏，使用头孢菌素应慎重，最好做过敏试验（E错）。